髓腔一侧形成较多的第三期牙本质的龋病为
A. 急性龋
B. 平滑面龋
C. 静止性龋
D. 浅龋
E. 慢性龋

正确答案：E。慢性龋

解析：慢性龋由于病程缓慢，有充足的时间刺激牙髓牙本质复合体在髓腔一侧形成较多的第三期牙本质，可以起到保护牙髓的作用。掌握“龋病的临床表现与分类”知识点。